绒毛膜癌常见的转移部位依次是
A. 肺、盆腔、肝、脑、阴道
B. 肺、阴道、盆腔、肝、脑
C. 肺、脑、盆腔、肝、阴道
D. 阴道、肺、盆腔、肝、脑
E. 肺、肝、阴道、盆腔、脑

正确答案：B。肺、阴道、盆腔、肝、脑

解析：绒毛膜癌常见的转移部位依次是肺（80%）、阴道（30%）、盆腔（20%）、肝（10%）、脑（10%）（B对）。